用食物交换份法为糖尿病患者编制食谱时，每一份交换份大致含有能量
A. 60～70kcal
B. 70～80kcal
C. 80～90kcal
D. 90～100kcal
E. 100～120kcal

正确答案：C。80～90kcal

解析：本题考查糖尿病食谱编制方法。用食物交换份法为糖尿病患者编制食谱时，每一份交换份大致含有能量80～90kcal（C对ABDE错）。